躯干和四肢意识性本体感觉传导通路中神经纤维
A. 延髓
B. 脊髓
C. 脑桥
D. 中脑
E. 无

正确答案：A。延髓

解析：躯干和四肢意识性本体感觉传导通路中神经纤维在锥体束的背侧呈前后方向排列，经过延髓（A对）。